嵌体的适应证，除了
A. 青少年恒牙
B. （牙合）面严重磨损需咬合重建
C. 邻（牙合）洞上要放置（牙合）支托
D. 邻面接触点破坏的牙体缺损
E. 以上都不是

正确答案：A。青少年恒牙

解析：本题考查嵌体的适应证。嵌体的适应证，除了青少年恒牙（A错，为本题的正确答案）。嵌体的适应证很广泛，（牙合）面严重磨损需咬合重建（B对）可以采用高嵌体修复。邻（牙合）洞上要放置（牙合）支托（C对）、邻面接触点破坏的牙体缺损（D对）用嵌体比直接充填修复能更好的恢复正常的咬合接触和邻面接触关系。但是青少年恒牙，由于还在生长发育，牙齿正在萌出，还未建立正常的咬合和邻接关系，不能采用任何永久修复方案，需尽量保存活髓，必要时诱导根尖成形，促使牙根继续发育和根尖孔封闭，待牙齿发育完全、建立正常咬合和邻接后，再选用合适的修复方法修复。